以下属于固位形的是
A. 鸠尾
B. 倒凹
C. 侧壁固位
D. 梯形
E. 以上都是

正确答案：E。以上都是

解析：本题考查窝洞的固位形。窝洞的固位形包括：鸠尾固位（A对）、倒凹固位（B对）、侧壁固位（C对）、梯形固位（D对）。（ABCD均对，故E为本题的正确答案）。